关于可信区间，正确的说法是
A. 可信区间是总体中大多数个体值的估计范围
B. 95％可信区间比99％可信区间更好
C. 不管资料呈什么分布，总体均数的95％的可信区间计算公式是一致的
D. 可信区间也可用于回答假设检验的问题
E. 可信区间仅有双侧估计

正确答案：D。可信区间也可用于回答假设检验的问题

解析：可信区间是按照一定的概率或可信度，用一个区间来估计总体参数所在的范围。该可信区间有多大的可能性，包含了总体均数。参考范围是正常人的解剖，生理，生化等指标的波动范围。可信区间用于估计总体均数。参考值范围用以判断观察对象某项指标是否正常。